心位于胸腔内与周围器官密切相关，是血液循环的核心器官。关于心的位置和毗邻关系，错误的是
A. 位于中纵隔内
B. 2/3在身体正中面的左侧，1/3在右侧
C. 下面与膈相邻
D. 前面全部被肺和胸膜覆盖
E. 后方平对第5～8胸椎

正确答案：D。前面全部被肺和胸膜覆盖

解析：心位于胸腔的中纵隔内（A对）。心约2/3位于正中线的左侧，1/3位于正中线的右侧（B对）。下面与膈相邻（C对）。两侧（D错，为本题正确答案）与胸膜腔和肺相邻。后方平对第5～8胸椎（E对）。